在下列哪种疾病情况下基础代谢率降低
A. 发热
B. 糖尿病
C. 甲状腺功能亢进
D. 红细胞增多症
E. 甲状腺功能低下

正确答案：E。甲状腺功能低下